构成传染病流行的三个基本条件是
A. 传染源、传播途径、易感者
B. 传染来源、传播途径、易感人群
C. 传染源、传播途径、易感人群
D. 传染来源、传播途径、免疫人群
E. 传染来源、传播途径、易感者

正确答案：C。传染源、传播途径、易感人群

解析：本题考查传染病流行的条件。构成传染病流行的三个基本条件为：传染源、传播途径和易感人群（C对ABDE错）。